与全冠咬合面形态设计无关的因素是
A. 固位因素
B. 抗力因素
C. 牙周状态
D. 邻（牙合）面形态
E. 对侧牙冠是否完好

正确答案：E。对侧牙冠是否完好

解析：本题考查与全冠咬合面形态设计有关的因素。全冠咬合面的设计与对侧牙冠是否完好（E错，为本题的正确答案）并无直接关系。全冠咬合面的形态设计是牙体缺损修复体的设计的一部分，要考虑抗力（A对）和固位（B对），目的是使修复体和基牙能够抵抗（牙合）力而不被破坏和折裂，使全冠固定在基牙上不因咀嚼外力而致移位脱落。咬合功能恢复的程度应与牙周条件（C对）相适应，必要时可以适当改变（牙合）面形态，否则若只追求功能的恢复会损伤基牙，导致松动使修复失败。全冠咬合面的设计也要考虑邻（牙合）面形态（D对），以保持整个牙列的功能、美观、协调。